执业医师法规定医师除正当治疗外，不得使用以下药品，除了
A. 麻醉药品
B. 医疗用毒性药品
C. 副作用大的药品
D. 精神药品
E. 放射性药品

正确答案：C。副作用大的药品

解析：医师应当使用经国家有关部门批准使用的药品、消毒药剂和医疗器械。除正当诊断治疗外，不得使用麻醉药品、医疗用毒性药品、精神药品和放射性药品。掌握“医师执业规则及培训、考核及法律责任”知识点。